易发生缺血坏死的是
A. 肱骨髁上骨折
B. 股骨颈骨折
C. 股骨干骨折
D. 腓骨上段骨折
E. 胫骨下1/3骨折

正确答案：B。股骨颈骨折

解析：股骨颈骨折包括股骨头下骨折、经股骨颈骨折和股骨基底骨折，其中股骨头下骨折发生股骨头缺血坏死的机会很大，故股骨颈骨折是最易发生缺血坏死的骨折（B对）。旋股内侧动脉损伤是导致股骨头缺血坏死的主要原因。易于发生缺血性坏死的骨折主要有以下几种：股骨颈头下型骨折、手部腕舟骨骨折等。其他四项发生后，由于周围有较为丰富的肌肉和血管提供血供，因此不易发生缺血坏死（ACDE错）。